经治疗后，患者空腹及餐后血糖多次正常，之后最不合适的处理为
A. 可停止药物治疗
B. 继续药物治疗，并随访血糖以调整剂量
C. 继续药物治疗，并根据糖血红蛋白随访疗效
D. 加用二甲双胍并调整原来药物剂量
E. 血脂仍高，加用降脂药物

正确答案：A。可停止药物治疗